肝门静脉位于
A. 肠系膜
B. 大网膜
C. 网膜囊
D. 肝十二指肠韧带
E. 肝胃韧带

正确答案：D。肝十二指肠韧带

解析：肝十二指肠韧带（D对）内有肝门静脉经过，肝门静脉在入肝门处分为两支，分别进入肝左叶和肝右叶。